动脉粥样硬化性心脏病患者的膳食原则不包括
A. 提高植物性蛋白的摄入，少吃脂肪
B. 食盐摄入在6-10g之间
C. 供给充足的微量营养素和膳食纤维
D. 限制总能量摄入，保持理想体重
E. 限制脂肪和胆固醇的摄入

正确答案：B。食盐摄入在6-10g之间

解析：动脉粥样硬化性心脏病患者的总膳食原则：应在平衡饮食的基础上控制总能量和总脂肪的摄入，限制饮食中饱和脂肪酸和胆固醇含量，保证充足的食物纤维和多种维生素，补充适量的矿物质和抗氧化营养素。具体的营养措施：①限制总能量摄入，保持理想体重（D对）②限制脂肪（总脂肪、饱和脂肪酸和反式脂肪酸）和胆固醇摄入（E对）③提高植物性蛋白的摄入，少吃甜食（A对）④摄入充足的膳食纤维⑤保证充足的维生素和微量元素（C对）⑥饮食清淡，少盐限酒：适当多吃保护性食品。因此，食盐摄入在6-10g之间不属于动脉粥样硬化性心脏病患者的膳食原则，且理想的膳食模式中每人每日食盐的摄入应不超过6g（B错，为本题正确答案）。